美蓝是哪种毒物中毒的特效解毒剂
A. 苯
B. 甲苯
C. 二甲苯
D. 苯胺
E. 二氯乙烷

正确答案：D。苯胺

解析：本题考查美蓝的解毒效果。短时间内吸收大量苯胺（D对ABCE错），可引起急性中毒，主要引起高铁血红蛋白血症，针对高铁血红蛋白血症的处理，常用小剂量亚甲蓝（美蓝）进行治疗。对于苯的氨基或硝基化合物中毒，应用小剂量亚甲蓝还原目前仍为最佳解毒治疗方式。